急性输血不良反应发生的时间为输血开始后
A. 48小时内
B. 36小时内
C. 8小时内
D. 24小时内
E. 12小时内

正确答案：D。24小时内

解析：输血不良反应是指输血过程中或输血后，受血者发生了用原来疾病不能解释的、新的症状或体征。按发生时间可分为急性输血反应和慢性输血反应，急性输血反应发生的时间为输血开始后的24小时内（D对）。